不属于水蛭性状特征的是
A. 扁平纺锤形或长圆柱形，有多数环节
B. 背部黑褐色或黑棕色，两侧棕黄色
C. 第14～16环节为生殖带，习称“白颈”
D. 两端各具一吸盘
E. 质脆，易折断，断面胶质样

正确答案：C。第14～16环节为生殖带，习称“白颈”